患者30岁，左下6远中邻（牙合）面因深龋治疗时不慎意外穿髓，穿髓孔一钻针大小。该患牙应如何处理
A. Ca（OH）₂制剂直接盖髓，羧酸水门汀垫底，银汞合金充填
B. Ca（OH）₂制剂直接盖髓，氧化锌丁香油糊剂安抚
C. Ca（OH）₂制剂直接盖髓，玻璃离子水门汀充填
D. 活髓切断术
E. 牙髓治疗

正确答案：E。牙髓治疗

解析：本题考查意外穿髓的治疗。患者30岁，左下6远中邻（牙合）面因深龋治疗时不慎意外穿髓，穿髓孔一钻针大小。该患牙应牙髓治疗（E对）。意外穿髓时的牙髓多为正常牙髓，处理应视患者年龄、患牙部位和穿髓孔大小而选择不同的处理方法。根据病例描述，患者30岁（牙根已发育完全），患牙深龋治疗时意外穿髓，穿髓孔一钻针大小（大于0.5mm），则深龋处的细菌可很快随穿髓孔进入牙髓腔中，感染牙髓，导致牙髓炎症，因此应该进行牙髓治疗。Ca（OH）₂制剂直接盖髓，羧酸水门汀垫底，银汞合金充填（A错）、Ca（OH）₂制剂直接盖髓，氧化锌丁香油糊剂安抚（B错）和Ca（OH）₂制剂直接盖髓，玻璃离子水门汀充填（C错）都属于直接盖髓术，适用于年轻恒牙的机械性或外伤性露髓以及根尖已发育完全的机械性或外伤性露髓，穿髓孔直径不超过0.5mm的恒牙，该病例中患牙根尖发育完全且穿髓孔大于0.5mm，故不能用直接盖髓术。活髓切断术（D错）适用于根尖未发育完全的年轻恒牙，不用于根尖发育完成的恒牙。